47岁男性。上颌前牙固定修复3年，现出现松动，咬合疼痛。口腔检查：左上2缺失，左上123烤瓷固定桥修复，左上13为烤瓷全冠固位体，边缘均不密合。左上1远中和左上3的近中邻面可探及深龋，左上3叩诊（++），牙龈红肿，无牙周袋。余牙健康，咬合正常。治疗前最需做的辅助检查是基牙的X线检查。原固定修复体松动原因是
A. 原固定修复体破损
B. 原固定修复体边缘不密合
C. 牙龈炎
D. 牙周炎
E. 基牙预备不良

正确答案：B。原固定修复体边缘不密合

解析：本题考查修复体松动脱落的原因。修复体松动脱落的原因：①修复体固位不足，如轴壁聚合度过大，（牙合）龈距过短而未设计辅助固位形，修复体不密合（B对），桩过短，固位形不良；②创伤，如（牙合）力过大，不良咀嚼习惯，（牙合）力集中，侧向力过大；③粘固失败，如粘固材料选用不当，粘固剂失效，粘接程序或操作不当，牙面及修复体粘固面未清洁干净，干燥不彻底，气枪喷气中含油、唾液、龈沟液或血液污染，粘固剂尚未完全结固时患者咀嚼破坏结固等。